制备煎膏剂应采用
A. 稀释法
B. 渗漉法
C. 浸渍法
D. 煎煮法
E. 水蒸气蒸馏法

正确答案：D。煎煮法

解析：本题考查的是煎膏剂的制备方法。制备煎膏剂应采用煎煮法（D对）。煎膏剂：系指中药饮片用水煎煮，煎液浓缩，加炼蜜或炼糖（或转化糖）制成的半流体制剂，俗称膏滋。煎煮法：是中药材加入水浸泡后加热煮沸，将有效成分提取出来的方法。此法简便，但含挥发性成分或有效成分遇热易分解的中药材不宜用此法。稀释法（A错）为酊剂与流浸膏剂的制备方法。渗漉法（B错）：是不断向粉碎的中药材中添加新鲜浸出溶剂，使其渗过药材，从渗漉筒下端出口流出浸出液的一种方法。但该法消耗溶剂量大、费时长，操作比较麻烦。浸渍法（C错）：是在常温或温热（60℃～80℃）条件下用适当的溶剂浸渍药材以溶出其中有效成分的方法。本法适用于有效成分遇热不稳定的或含大量淀粉、树胶、果胶、黏液质的中药的提取。但本法出膏率低，需要特别注意的是当水为溶剂时，其提取液易于发霉变质，需注意加入适当的防腐剂。水蒸气蒸馏法（E错）：适用于具有挥发性的、能随水蒸气蒸馏而不被破坏，且难溶或不溶于水的化学成分的提取。此类化合物的沸点多在100℃以上，并在100℃左右有一定的蒸气压。